脊髓节段与椎骨的对应关系
A. 第3腰髓平对第2腰椎
B. 第7胸髓平对第7胸椎
C. 第3颈髓平对第3颈椎
D. 骶髓平对第2腰椎
E. 所有腰髓平对第12胸椎

正确答案：C。第3颈髓平对第3颈椎

解析：第3腰髓平对第10-12胸椎（A错），.第7胸髓平对第5胸椎（B错），第3颈髓平对第3颈椎（C对），骶髓平对第1腰椎（D错），所有腰髓平对第10-12胸椎（E错）。